对高总胆固醇血症者应首选的血脂调节药是
A. 羟甲戊二酰辅酶A还原酶抑制剂
B. 烟酸缓释剂
C. 胆酸螯合剂
D. 贝丁酸类
E. 脂酶抑制剂

正确答案：A。羟甲戊二酰辅酶A还原酶抑制剂

解析：本题考查调血脂药。HMG-CoA还原酶抑制剂（A对）为高总胆固醇血症者首选。烟酸缓释剂（B错）适应证为高三酰甘油症和以三酰甘油升高为主的混合型高脂血症。胆酸螯合剂（C错）是一类安全有效的降低血浆TC和LDL-C药物，但不是高总胆固醇血症者首选药。贝丁酸类（D错）是高三酰甘油血症者首选的血脂调节药。脂酶抑制剂（E错）能抑制脂酶的活性，对高总胆固醇血症者作用较小。